下述关于执行脑死亡标准的伦理意义的提法中，最易引发争执的是
A. 有利于科学地确定死亡，真正维护人的生命
B. 有利于医生对病人积极抢教还是放弃治疗进行正确抉择
C. 有利于节约医疗卫生资源
D. 有利于公正分配卫生资源
E. 有利于器官移植的开展

正确答案：E。有利于器官移植的开展